有明显出血倾向的病毒性肝炎是
A. 急性黄疸型
B. 慢性肝炎重度
C. 重型
D. 淤胆型
E. 慢性肝炎中度

正确答案：C。重型

解析：重型肝炎（肝衰竭）的病因及诱因复杂，包括重叠感染（如乙型肝炎重叠其他肝炎病毒感染）、HBV前C区突变、机体免疫状况、妊娠、过度疲劳、精神刺激、饮酒、应用肝损药物、合并细菌感染、有其他合并症（如甲状腺功能亢进、糖尿病）等。其主要临床表现为一系列肝衰竭症候群：极度乏力，严重消化道症状，神经、精神症状（嗜睡、性格改变、烦躁不安、昏迷等），有明显出血倾向（C对），凝血酶原时间第十版传染病学（PT）显著延长及凝血酶原活动度第十版传染病学（PTA）<40%；黄疸进行性加深，胆红素每日上升≥17.1μmol/L或大于正常值10 倍；可出现中毒性鼓肠、肝臭及肝肾综合征等；可见扑翼样震颤或病理反射；肝浊音界进行性缩小；胆酶分离；血氨升高等。